显露组织的解剖部位、保护正常和重要组织、切除病变组织从而完成手术的重要手段是
A. 打结
B. 组织分离技术
C. 电凝止血
D. 切开
E. 铺巾

正确答案：B。组织分离技术

解析：分离是显露组织的解剖部位、保护正常和重要组织、切除病变组织从而完成手术的重要手段。掌握“口外手术组织切开、止血及组织分离”知识点。